药师进行药学服务应具备的专业技能包括
A. 患者教育技能
B. 沟通技能
C. 疾病诊断技能
D. 药历书写技能
E. 药物警戒技能

正确答案：A、B、D、E。患者教育技能；沟通技能；药历书写技能；药物警戒技能

解析：本题考查专业技能。药师应具备的专业技能包括：调剂、咨询与用药教育（A对）、药品管理、沟通（B对）、药历书写（D对）、药物警戒（E对）、投诉与应对及自主学习。疾病诊断技能（C错）是医生应具备的专业技能。